慢性阻塞性肺病稳定期患者（FEV1＜50%）宜选用的治疗方案是
A. 长效β₂受体激动剂+吸入型糖皮质激素
B. 吸入型糖皮质激素+磷酸二脂酶抑制剂
C. 抗菌药物+短效支气管舒张剂+糖皮质激素
D. 吸入型糖皮质激素+镇咳药+抗过敏药
E. 吸入型糖皮质激素+祛痰药+镇咳药

正确答案：A。长效β₂受体激动剂+吸入型糖皮质激素

解析：本题考查慢性阻塞性肺疾病用药。慢性阻塞性肺病稳定期患者（FEV1＜50%）宜选用的治疗方案是长效β₂受体激动剂+吸入型糖皮质激素（A对）。慢性阻塞性肺病稳定期患者应长期规律吸入糖皮质激素+长效β₂受体激动剂。抗菌药物+短效支气管舒张剂+糖皮质激素（C错）是慢性阻塞性肺病急性加重期伴脓痰者宜选用的治疗方案。